专家鉴定组成员是当事人的近亲属应遵循
A. 回避原则
B. 公正原则
C. 合议制原则
D. 医学会原则
E. 独立鉴定原则

正确答案：A。回避原则

解析：回避原则:专家鉴定组成员有下列情形之一的，应当回避，当事人也可以以口头或者书面的方式申请其回避：①是医疗事故争议当事人或者当事人的近亲属的；②与医疗事故争议有利害关系的；③与医疗事故争议当事人有其他关系，可能影响公正鉴定的。掌握“医疗事故的技术鉴定”知识点。